机体维生素D的最好来源是
A. 牛肉
B. 牛奶
C. 猪肝
D. 深海鱼油
E. 晒太阳

正确答案：E。晒太阳